肱骨髁上骨折，有尺侧侧方移位，未能矫正时，最常见的后遗症
A. 肘关节后脱位
B. 尺神经损伤
C. 肘内翻畸形
D. 肘关节前脱位
E. 前壁缺血性肌挛缩

正确答案：C。肘内翻畸形

解析：肱骨髁上骨折，有尺侧侧方移位，未能矫正时，在骨折愈合后，最常出现肘内翻畸形（C对）。肱骨髁上骨折患者，肘后关系正常，不会出现肘关节前后脱位（AD错）。伸直型肱骨髁上骨折可有尺神经损伤（B错），屈曲型肱骨髁上骨折较少合并血管神经损伤。前臂缺血性肌挛缩（E错）为前臂骨筋膜室综合征处理不当的严重后果。